某女，72岁。左下肢静脉曲张病史20年，平素腰膝酸软。6天前左下肢静脉曲张处出现青紫色，呈条索状凸起，疼痛难忍，行走困难，由家属搀扶走入诊室。大便干结3天。医师检查：左下肢红肿，大小约5cm×15cm，体温38.9℃。舌红、苔黄、脉弦数。证属血热毒盛、脉络瘀阻。处以丹参、虎杖、大青叶、络石藤、金银花、川牛膝、防己、大血藤、生甘草。方中投用虎杖，因其除能活血祛瘀、泻下通便外，又能
A. 行气止痛
B. 续筋接骨
C. 凉血平肝
D. 清热解毒
E. 软坚消肿

正确答案：D。清热解毒

解析：本题考查虎杖的功效。方中投用虎杖，因其除能活血祛瘀、泻下通便外，又能清热解毒（D对）。虎杖【功效】利湿退黄，清热解毒，活血祛瘀，化痰止咳，泻下通便。木香【功效】行气止痛（A错），健脾消食。土鳖虫【功效】破血逐瘀，续筋接骨（B错）。赭石【功效】平肝潜阳，重镇降逆，凉血（C错）止血。金银花【功效】清热解毒（D错），疏散风热。昆布【功效】消痰软坚，利水消肿（E错）。